肺热壅盛，喘促气急，治疗宜与平喘药配伍的是
A. 栀子
B. 芦根
C. 石膏
D. 夏枯草
E. 淡竹叶

正确答案：C。石膏

解析：治疗肺热壅盛，喘促气急，在应用平喘药的基础上，还应治疗肺热壅盛，清肺之实热。栀子能泻三焦火邪，治疗热病心烦（A错）。芦根甘寒，入肺经善清透肺热，常配化痰药和解表药，用于治疗肺热咳嗽（B错）。石膏辛寒入肺经，善清肺经实热，常平喘药治疗肺热喘咳证（C对）。夏枯草善泻肝火以明目，用于治疗肝火上炎之目赤肿痛（D错）。淡竹叶甘寒，主归心经，能清心火以除烦，入胃经而泄胃火以止渴，用于治疗热病烦渴，不能清肺热（E错）。